不属于药物制剂化学性配伍变化的是
A. 维生素C泡腾片放入水中产生大量气泡
B. 头孢菌素遇氯化钙溶液产生头孢烯-4羧酸钙沉淀
C. 两性霉素B加入复方氯化钠输液中，药物发生凝聚
D. 多巴胺注射液与碳酸氢钠注射液配伍后会变成粉红至紫色
E. 维生素C与烟酰胺混合变成橙红色

正确答案：C。两性霉素B加入复方氯化钠输液中，药物发生凝聚

解析：本题考查药物的配伍变化。两性霉素B加入复方氯化钠输液中，药物发生凝聚（C错，为本题正确答案）属于盐析作用，而非化学性配伍变化。胶体分散体系加到含有电解质的输液中，会因盐析作用而产生凝聚。如两性霉素B注射液，只能加入5%葡萄糖注射液中静脉滴注。如果在大量电解质的输液中则能被电解质盐析出来，以致胶体粒子凝聚而产生沉淀。维生素C泡腾片放入水中产生大量气泡（A对）、头孢菌素遇氯化钙溶液产生头孢烯-4羧酸钙沉淀（B对）、多巴胺注射液与碳酸氢钠注射液配伍后会变成粉红至紫色（D对）、维生素C与烟酰胺混合变成橙红色（E对）均为化学性配伍变化。